芡实的功效是
A. 清心除烦
B. 补益肝肾
C. 养心安神
D. 补脾祛湿
E. 益气养阴

正确答案：D。补脾祛湿

解析：本题考查的是芡实的功效。芡实的功效是补脾祛湿（D对）。芡实：【功效】补脾祛湿，益肾固精。栀子：【功效】泻火除烦，清热利尿，凉血解毒，消肿止痛。栀子仁（用种子）善清心除烦（A错），栀子皮（用果皮）兼清表热。山茱萸：【功效】补益肝肾（B错），收敛固脱。莲子肉：【功效】补脾止泻，益肾固精，止带，养心安神（C错）。山药：【功效】益气养阴（E错），补脾肺肾，固精止带。